细菌性肝脓肿鉴别诊断中，有无Charcot三联征主要用于鉴别
A. 急性胆管炎
B. 阿米巴肝脓肿
C. 原发性肝癌
D. 急性胆囊炎
E. 右膈下脓肿

正确答案：A。急性胆管炎

解析：细菌性肝脓肿主要应与阿米巴性肝脓肿鉴别（P415表38-2）。细菌性肝脓肿：继发于胆道感染或其他化脓性疾病，多有糖尿病病史，病情急骤严重，全身中毒症症状明显，有寒战、高热，部分病人可有黄疸。阿米巴性肝脓肿（B错）：继发于阿米巴痢疾后，起病较缓慢，病程较长，可有高热，或不规则发热、盗汗，黄疸少见。急性胆管炎（A对）特有体征：Charcot三联征（高热，腹痛，黄疸）（P446）。原发性肝癌（C错）：有肝炎等肝病病史，甲胎蛋白（AFP） ≥400ng/ml，超声、CT或MRI检查发现肝实质性肿块（P418）。急性胆囊炎（D错）特有体征：Murphy征阳性（P443）。右膈下脓肿（E错）：可由肝右叶脓肿穿破肝包膜形成（P415），X线透视可见病侧膈肌升高，随呼吸活动受限或消失，肋膈角模糊、积液。X线平片显示胸膜反应、胸腔积液、肺下叶部分不张等；膈下可见占位阴影（P333）。